陕西某高校一位副教授因高热住进职工医院，经B超、CT、抽血、抽骨髓化验等检查后，难以确诊。医生恐延误病情，于是给予高级抗生素治疗，但病情不好转。第16天，该院请某市医院会诊，仍依据上述检查结果而诊断为病毒性感冒，给予相应治疗后仍无济于事。病人在这两家医院里诊治达20多天，花费近万元，仍无明确诊断。后来，医院只好请西安医大第一附属医院某教授会诊。该教授并未盲目用理化检验手段，而是仔细问诊查体，当在病人身上发现了3个极易被忽视的小红点时，病情很快得到确诊：原来是病人在不久前游览西双版纳时被蚊虫叮咬，导致斑疹伤寒。确诊后，病人家属遵医嘱到药店花1.2元钱买了20片四环素，病人口服后痊愈。医疗仪器，尤其是高科技手段大量进入临床，要求临床医师注意防范的伦理问题应除外
A. 盲目购进，不能充分利用
B. 仪器检查代替医师问诊
C. 仪器检查代替医师查体
D. 仪器检查代替医德、责任心
E. 滥开检查单，不能合理利用

正确答案：A。盲目购进，不能充分利用